在药店从事执业活动的执业药师，应遵循药学职业道德规范包括
A. 为患者提供疗效确切的药品
B. 注意保护消费者的隐私
C. 根据报酬提供适合的药学服务
D. 随时注意收集并记录药品不良反应
E. 实事求是地介绍药品的疗效、副作用与不良反应

正确答案：B、D、E。注意保护消费者的隐私；随时注意收集并记录药品不良反应；实事求是地介绍药品的疗效、副作用与不良反应

解析：本题考查药品零售的道德要求。药品零售的道德要求：1．诚实守信，确保销售质量：布置明亮整洁的店堂环境，药品按规定陈列，明码标识药价。销售药品时，不夸大药效，不虚高定价，实事求是地介绍药品的疗效、副作用与不良反应（E对）。注意保护消费者隐私（B对）。对于不能进行自我药疗的患者，提供寻求医师帮助的建议。2．指导用药，做好药学服务：随时注意收集并记录药品不良反应（D对），建立不良反应报告制度和台帐，并按规定上报，做到时时把消费者的利益放在首位。